男，56岁，突发胸闷心悸3小时，血压80/50mmHg，心率200次/分，查体：律齐，四肢湿冷，心电图示宽大QRS波心动过速，需立即处理的是
A. 静脉注射胺碘酮
B. 静脉注射利多卡因
C. 静脉注射西地兰
D. 静脉注射维拉帕米
E. 同步直流电复律

正确答案：E。同步直流电复律

解析：患者男，56岁，出现突发胸闷心悸3小时，血压80/50mmHg，心率200次/分，查体：律齐，四肢湿冷，心电图示宽大畸形QRS波，考虑室性期前收缩，血压低，心率快，休克，考虑室性心动过速合并血流动力学不稳定，需立即处理的是同步直流电复律（E对）。